舌体和舌根联合相连于界沟是在
A. 胚胎第5周
B. 胚胎第6周
C. 胚胎第7周
D. 胚胎第8周
E. 胚胎第9周

正确答案：B。胚胎第6周

解析：在两个侧舌隆突之间，有一个三角形的小突起，位置稍低，称奇结节。在胚胎第6周时，侧舌隆突迅速增大，相互联合，并与奇结节联合发育成舌体。因奇结节较小，联合后被两个侧舌隆突所掩盖，结果只能看到很小的一部分，或完全消失。同时第2、3、4鳃弓中线处的间充质增生，在背侧面形成一个联合突发育成舌根。舌体和舌根也在第6周时联合，相连于界沟。舌体表面覆盖着外胚层上皮，舌根表面覆盖内胚层上皮，界沟所在的位置也就是原来口咽膜所在的位置。掌握“腭部与舌的发育”知识点。